可摘局部义齿中起辅助固位和增强稳定作用的部分是
A. 卡环
B. 连接体
C. 基牙
D. 间接固位体
E. 人工牙

正确答案：D。间接固位体

解析：间接固位体：防止义齿翘起、摆动、旋转、下沉的固位体，称为间接固位体。间接固位体具有辅助直接固位体固位和增强义齿稳定的作用。掌握“局部义齿人工牙及基托”知识点。